主要阻滞电压依赖性的钠通道，属于二苯并氮䓬类抗癫痫药的是
A. 卡马西平
B. 苯妥英钠
C. 加巴喷丁
D. 苯巴比妥
E. 氯硝西泮

正确答案：A。卡马西平

解析：本题考查二苯并氮䓬类抗癫痫药。卡马西平（A对）属于二苯并氮䓬类抗癫痫药，其抗癫痫机制为阻滞电压依赖性的钠通道，阻断神经递质释放，从而调节神经兴奋性，达到抗惊厥作用；苯妥英钠（B错）通过减少钠离子内流而使神经细胞膜稳定；氯硝西泮（E错）为GABA受体激动剂，可加强突触前抑制，起抗惊厥作用；加巴喷丁（C错）属于γ-氨基丁酸类似物，增加脑组织GABA的释放；苯巴比妥（D错）通过增强γ-氨基丁酸A型受体活性，抑制谷氨酸兴奋性，抑制中枢神经系统单突触和多突触的传递，增加运动皮质的电刺激阈值，从而提高癫痫发作的阈值。